贝尔面瘫患者急性期最恰当的治疗方法是
A. 大剂量激素+阿司匹林+神经营养药
B. 立即行面神经管减压术
C. 尽快给予强电流刺激，促进肌运动
D. 大剂量激素+肌兴奋剂
E. 阿司匹林+神经营养药

正确答案：A。大剂量激素+阿司匹林+神经营养药

解析：本题考查贝尔面瘫的急性期治疗方法。贝尔面瘫患者急性期最恰当的治疗方法是大剂量激素+阿司匹林+神经营养药（A对）。急性期治疗的主要原则是控制炎症水肿，改善局部血液循环，减少神经受压，此期应用大剂量激素+阿司匹林+神经营养药（A对E错）最为恰当，大剂量激素+阿司匹林可控制消炎水肿，神经营养药可促进神经髓鞘修复。肌电刺激（C错）是恢复期加强肌收缩的治疗方法，并非急性期。面神经管减压术（B错）、肌兴奋剂（D错）不是贝尔面瘫的治疗方法。